男，12岁。持续发热1周。体温39℃左右，伴畏寒，无寒战，伴有全身不适、乏力，食欲差，病情逐渐加重并出现红疹1天来诊。查体：躯干部出现少许淡红色小斑丘疹，压之褪色。初步考虑诊断为
A. 水痘
B. 麻疹
C. 天花
D. 伤寒
E. 猩红热

正确答案：D。伤寒

解析：患者男性儿童。持续发热1周。体温39℃左右（中高热，中度热，高热39.1～41℃），伴畏寒，无寒战，伴有全身不适、乏力，食欲差，病情逐渐加重并出现红疹1天。查体见躯干部出现少许淡红色小斑丘疹，压之褪色（充血点）。根据患者临床表现、体格检查，诊断为伤寒，伤寒（D对）有持续高热，全身乏力，畏寒、无寒战，分布于躯干、压之褪色的斑丘疹。水痘（A错）为低热，向心性分布，首先出现于躯干和头部、后遍及面部及四肢，斑丘疹、水疱、结痂同时存在，无压之褪色的斑丘疹（P69）。麻疹（B错）表现为发热、咳嗽、流涕、眼结合膜炎和特征性口腔麻疹粘膜斑（P63）。天花（C错）是烈性传染病，主要为严重毒血症状（寒颤、高热、乏力、头痛、四肢及腰背部酸痛，体温急剧升高时可出现惊厥、昏迷）、皮肤成批依次出现斑疹、丘疹、疱疹、脓疱，最后结痂、脱痂，遗留痘疤，1979年世界卫生组织宣布天花彻底消灭。猩红热（E错）为全身弥漫性鲜红色皮疹和疹后明显脱屑，压之褪色（P203）。